某女，65岁，患有冠心病，伴慢性心功能不全，表现为心慌气短、动则加剧、下肢浮肿、倦怠乏力等症状，医师开具益气温阳、活血通络、利水消肿中药汤剂（黄芪、人参、黑顺片、丹参、葶苈子、水蛭、泽泻、桂枝、红花、香加皮），患者服用3剂后出现恶心、呕吐、腹泻、心率减慢、早搏等临床症状。该患者服用的汤药中，与出现的不良反应症状相关的中药是
A. 黄芪
B. 水蛭
C. 香加皮
D. 桂枝
E. 葶苈子

正确答案：C。香加皮

解析：本题考查的是中药饮片的不良反应。医师开具益气温阳、活血通络、利水消肿中药汤剂（黄芪、人参、黑顺片、丹参、葶苈子、水蛭、泽泻、桂枝、红花、香加皮），患者服用3剂后出现恶心、呕吐、腹泻、心率减慢、早搏等临床症状。该患者服用的汤药中，与出现的不良反应症状相关的中药是香加皮（C对）。香加皮的不良反应表现：①消化系统：主要为恶心、呕吐、腹泻等胃肠道症状。②心血管系统：主要为心律失常，如心率减慢、早搏、房室传导阻滞等。动物毒性实验表明香加皮中毒后多表现为血压先升而后下降、心肌收缩力增强、每分钟心输出量增加，继而心输出量减弱、心律失常，乃至心肌纤颤而死亡。黄芪（A错）、水蛭（B错）、桂枝（D错）、葶苈子（E错）的不良反应，2022年考试指南未明确说明。